慢性肾小球肾炎，GFR65ml/min，最主要的治疗是
A. 应用β-受体阻滞剂
B. 应用α-酮酸
C. 低蛋白饮食
D. 应用包醛氧化淀粉
E. 应用ACEI

正确答案：E。应用ACEI

解析：慢性肾炎的治疗是以防止或延缓肾功能恶化、改善或缓解临床症状及防治心脑血管并发症为主要目的，其中积极控制高血压和减少尿蛋白是两个重要的环节。ACEI在降压的同时可减少尿蛋白，为治疗慢性肾炎高血压和（或）减少蛋白尿的首选药物。肾功能不全患者应用ACEI或ARB要防止高血钾，血肌酐大于264mol/L（3mg/dl）时务必在严密观察下谨慎使用。GFR65ml/（min·1.73m²），此时肾功能为CKD2期，血肌酐仍正常，可以选用ACEI（E对）。β-受体阻滞剂（A错）虽与ACEI同为降压药，但无减少蛋白尿和延缓肾功能恶化的肾脏保护作用，因此其对慢性肾炎的治疗效果不如ACEI。α-酮酸（B错）可提供必需氨基酸并尽量减少氨基氮的摄入，配合低蛋白饮食，预防和治疗因慢性肾功能不全而造成蛋白质代谢失调引起的损害。通常用于肾小球滤过率低于每分钟25毫升的患者。包醛氧化淀粉（D错）可吸附肠道中的尿素氮，故能代偿肾功能、降低血液中非蛋白氮和尿素氮的浓度，从而发挥治疗作用，适用于各种原因造成的氮质血症，慢性肾小球肾炎应予以低蛋白饮食（C错）以减轻肾脏的负担，以上均是慢性肾小球肾炎的治疗措施，最主要的治疗是应用ACEI。